国家药品标准中，原料药的含量限度，如未规定上限时，系指上限不超过
A. 0.95
B. 0.99
C. 1
D. 1.01
E. 1.05

正确答案：D。1.01

解析：本题考查国家药品标准。国家药品标准中，原料药的含量限度，如未规定上限时，系指上限不超过101.0%（D对）。原料药的含量（%），除另有注明者外，均按重量计；如规定上限为100%以上时，是指用《中国药典》规定的分析方法测定时可能达到的数值，它为《中国药典》规定的限度或允许偏差，并非真实含量；如未规定上限时，指其上限不超过101.0%。